身高指头顶至足底的长度，身长指
A. 1岁以下仰卧位测量
B. 2岁以下仰卧位测量
C. 3岁以下仰卧位测量
D. 4岁以下仰卧位测量
E. 3～4岁以下仰卧位测量

正确答案：C。3岁以下仰卧位测量

解析：身高指头顶至足底的长度，3岁以下仰卧位测量称身长，3岁以后站立位测量称身高。掌握“体格生长常用指标”知识点。